性发育迟缓分类
A. 指超过正常青春期开始平均年龄2.5个标准差以上尚无性成熟发育者
B. 分为体质性延迟、低促性腺激素性腺功能延迟、高促性腺激素性腺技能减退
C. 重视心理疏导，积极防治全身慢性病，改善营养状况
D. 患有中枢神经系统或卵巢肿瘤者，可用性激素替代疗法
E. 年龄达12岁尚无月经来潮、无第二性征发有称性发育迟缓

正确答案：B。分为体质性延迟、低促性腺激素性腺功能延迟、高促性腺激素性腺技能减退

解析：本题考查性发育迟缓的分类。性发育迟缓分为：体质性延迟、低促性腺激素性腺功能延迟、高促性腺激素性腺技能减退（B对ACDE错）。